强烈酸水解法水解强心苷，其主要产物是
A. 真正苷元
B. 脱水苷元
C. 次级苷
D. 二糖
E. 三糖

正确答案：B。脱水苷元

解析：本题考查的是强心苷的酸水解反应。强烈酸水解法水解强心苷，其主要产物是脱水苷元（B对）。强心苷的酸水解：①温和酸水解：用稀酸如0.02～0.05mol/L的盐酸或硫酸，在含水醇中经短时间加热回流，可使Ⅰ型强心苷水解为苷元（A错）和糖。因为苷元和α-去氧糖之间、α-去氧糖与α-去氧糖之间的糖苷键极易被酸水解，在此条件下即可断裂。而α-去氧糖与α-羟基糖、α-羟基糖与α-羟基糖之间的苷键在此条件下不易断裂，常常得到二糖（D错）或三糖（E错）。由于此水解条件温和，对苷元的影响较小，不致引起脱水反应，对不稳定的α-去氧糖亦不致分解。此法不宜用于16位有甲酰基的洋地黄强心苷类的水解，因16位甲酰基即使在这种温和的条件下也能被水解。②强烈酸水解：Ⅱ型和Ⅲ型强心苷中苷元直接相连的均为α-羟基糖，由于糖的α-羟基阻碍了苷键原子的质子化，使水解较为困难，用温和酸水解无法使其水解，必须增高酸的浓度（3%～5%），延长作用时间或同时加压，才能使α-羟基糖定量地水解下来。但常引起苷元结构的改变，失去一分子或数分子水形成脱水苷元，而得不到原生苷元。③氯化氢-丙酮法（Mannich和Siewert法）：将强心苷置于含1%氯化氢的丙酮溶液中，20℃放置2周。因糖分子中C-2羟基和C-3羟基与丙酮反应，生成丙酮化物，进而水解，可得到原生苷元和糖衍生物。例如铃兰毒苷的水解。本法适合于多数Ⅱ型强心苷的水解。但是，多糖苷因极性太大，难溶于丙酮中，则水解反应不易进行或不能进行。此外，也并非所有能溶于丙酮的强心苷都可用此法进行酸水解，例如黄夹次苷乙用此法水解只能得到缩水苷元。强心苷水解生成次级苷（C错）的反应为酶水解反应。强心苷的酶水解：酶水解有一定的专属性。不同性质的酶，作用于不同性质的苷键。在含强心苷的植物中，有水解葡萄糖的酶，但无水解α-去氧糖的酶，所以能水解除去分子中的葡萄糖，而得到保留α-去氧糖的次级苷。